60岁女性患者，2个半月前有车祸头受伤史，当时有一过性意识障碍，伤后头痛，逐渐好转，近半个月又出现头痛，越来越重，头颅CT示右额颞顶低密度新月状影像，脑室中线受压移位，诊断是
A. 右额颞顶急性硬膜下血肿
B. 右额颞顶慢性硬膜下血肿
C. 右额颞顶急性硬膜外血肿
D. 右额颞顶慢性硬膜外血肿
E. 右额颞顶硬膜下积液

正确答案：B。右额颞顶慢性硬膜下血肿

解析：老年女性患者，2个半月前头部外伤史，当时有一过性意识障碍，伤后头痛，好转后疼痛再次加重（颅内压增高的表现），头颅CT示右额颞顶低密度新月状影像（慢性硬膜下血肿的典型影像学表现），结合患者病史、临床表现和影像学检查，应诊断为右额颞顶慢性硬膜下血肿（B对）。急性颅内血肿指伤后3天以内出现症状的颅内血肿，该患者于伤后2个多月才出现明显症状，故排除急性硬膜下血肿（A错）、急性硬膜外血肿（C错）。慢性硬膜外血肿（D错）多见于青年男性，主要表现为进行性头痛、恶心、呕吐，绝大多数患者伴有颅骨骨折，CT表现为双凸透镜形的低密度影。硬膜下积液（E错）又称硬膜下水瘤，多为外伤后硬膜下腔出现的脑脊液积聚，可分为急性和慢性两种，以慢性者多见，多表现为逐渐加重的颅内压增高症状，但一般无中间清醒期。